下列哪种过敏性疾病与季节有关
A. 多形性红斑
B. 药物过敏性口炎
C. 过敏性接触性口炎
D. 血管神经性水肿
E. 中毒性表皮坏死松解症

正确答案：A。多形性红斑

解析：本题考查与季节有关的过敏性疾病。多形性红斑（A对）常发生在春秋季节，原因是春天花粉较多，花粉可作为变应原诱发此病。另外春秋季节温度变化大，突然遭受寒冷刺激亦可诱发该病。药物过敏性口炎（B错）及中毒性表皮坏死松解症（E错）是由某些药物作用于过敏体质的人群引起的，与季节无关。过敏性接触性口炎（C错）临床常见为修复材料引起的接触性口炎和银汞合金或金属冠引发的超敏反应，与季节因素无关。血管神经性水肿（D错）与食物、药物、感染因素，精神因素等有关，与季节无关。